适用于牛奶与酒精消毒的灭菌方法是
A. 焚烧法
B. 烧灼法
C. 巴氏消毒法
D. 煮沸法
E. 高压蒸汽灭菌法

正确答案：C。巴氏消毒法

解析：巴氏消毒法常用于牛奶与酒精的消毒，方法是加热62℃30分钟或71.1℃15～30秒，不使蛋白质变性，但可杀灭常见致病菌。掌握“消毒与灭菌”知识点。